在中国药典中，采用酸碱滴定法测定含量的药物有
A. 阿司匹林
B. 布洛芬
C. 黄体酮
D. 维生素C
E. 庆大霉素

正确答案：A、B。阿司匹林；布洛芬

解析：本题考查药物含量测定方法。阿司匹林（A对）和布洛芬（B对）结构中的游离羧基具有酸性，可用酸碱滴定法测定含量。